属于第三代头孢菌素，常规每日给药1次的抗菌药物是
A. 头孢噻肟
B. 头孢哌酮
C. 头孢唑林
D. 头孢曲松
E. 头孢美唑

正确答案：D。头孢曲松

解析：本题考查头孢类抗菌药物的分类及应用。头孢曲松（D对）为第三代头孢菌素，常规每日给药1次。头孢噻肟（A错）为第三代头孢菌素，一日2～6g，分2～3次静脉注射或静脉滴注；严重感染者每6～8小时2～3g，一日最高剂量不超过12g。治疗无并发症的肺炎链球菌肺炎或急性尿路感染，每12小时1g。头孢哌酮（B错）为第三代头孢菌素，一般感染，一次1～2g，每12小时1次；严重感染，一次2～3g，每8小时1次。接受血液透析者，透析后应补给1次剂量。头孢唑林（C错）为第一代头孢菌素。头孢美唑（E错）是一种半合成的头霉素衍生物，抗菌性能与第二代头孢菌素相近。